有关玻璃体的叙述何者错误
A. 为无色透明的胶状物质
B. 位于晶状体和视网膜之间
C. 表面覆被玻璃体膜
D. 邻近视神经盘处凹陷称玻璃体凹
E. 无

正确答案：D。邻近视神经盘处凹陷称玻璃体凹

解析：玻璃体是无色透明的胶状物质（A对），表面覆被玻璃体膜（C对），位于晶状体与视网膜之间（B对）。玻璃体凹是玻璃体邻近晶状体处的凹陷（D错，为本题正确答案），而非临近视神经盘处的凹陷。